下列反应中由细胞色素P450酶系催化的是
A. 单胺氧化
B. 黄嘌呤氧化
C. S-氧化
D. 醛脱氢
E. 醇脱氢

正确答案：C。S-氧化